复方樟脑酊需
A. 零售企业凭盖有医疗单位公章的医生处方限量供应
B. 实行专库（柜）、双人、双锁保管
C. 两者均需
D. 两者均不需

正确答案：B。实行专库（柜）、双人、双锁保管

解析：本题考查复方樟脑酊。复方樟脑酊需实行专库（柜）、双人、双锁保管（B对）。复方樟脑酊属于麻醉药品，麻醉药品和第一类精神药品入出库实行双人核查制度，药品入库须双人验收，出库须双人复核，做到账、物相符。麻醉药品和第一类精神药品不得零售。除经批准的药品零售连锁企业外，其他药品零售企业不得从事第二类精神药品零售活动。复方樟脑酊需要实行专库专柜、双人双锁保管但不允许零售企业凭盖有医疗单位公章的医生处方限量供应（A错）。